汗证营卫失调的主症是
A. 自汗为主，头部、肩背部明显
B. 自汗为主，汗出遍身而不温
C. 盗汗为主，手足心热
D. 自汗或盗汗，头部、四肢为多
E. 盗汗为主，遍身汗出

正确答案：B。自汗为主，汗出遍身而不温

解析：汗证多属虚证，自汗以气虚、阳虚为主，盗汗以阴虚、血虚为主。营卫失调，卫气不能外固，营阴不能内守，津液固摄失调而外泄发为汗证，以汗出遍身而抚之不温，畏寒恶风为主症（B对ACDE错）。